妊娠33周。反复无痛性阴道出血3次，最可能的诊断是
A. 前置血管
B. 葡萄胎
C. 子宫破裂
D. 胎盘早剥
E. 前置胎盘

正确答案：E。前置胎盘

解析：妊娠33周（28周及其后为晚期妊娠），反复无痛性阴道出血，结合病史，最可能的诊断是前置胎盘（E对），前置胎盘是妊娠晚期阴道流血最常见的原因，其典型症状为妊娠晚期或临产时，无诱因、无痛性反复阴道流血。前置血管（A错）（P141）是指胎膜上的血管跨过宫颈内口位于胎先露部前方的现象，当胎膜破裂时，伴前置血管破裂出血达200～300ml时可导致胎儿死亡；若前置血管受胎先露部压迫，可导致脐血循环受阻，胎儿窘迫或死亡。葡萄胎（B错）（P334）因妊娠后胎盘绒毛滋养细胞增生、间质水肿，而形成大小不一的水泡，水泡间借蒂相连成串，形如葡萄而名之，也称水泡状胎块；表现为停经后阴道流血（一般在停经8～12周）、子宫异常增大、妊娠呕吐、子痫前期征象、甲状腺功能亢进、腹痛、卵巢黄素化囊肿。子宫破裂（C错）（P218）是指妊娠晚期或分娩期子宫体部或子宫下段发生裂开，多发生于分娩期；典型的子宫破裂有下腹剧痛、心率增快、低容量休克等表现；不完全性子宫破裂仅在不全破裂处有压痛，多有胎心率异常，一般无阴道出血。胎盘早剥（D错）（P129）指妊娠20周后或分娩期，正常位置的胎盘在胎儿娩出前，部分或全部从子宫壁剥离；Ⅰ度多见于分娩期，Ⅱ度常有突发持续性腹痛、腰痛或腰背痛的症状，Ⅲ度表现较Ⅱ度重，可出现恶心、呕吐、面色苍白、四肢湿冷、脉搏细数、血压下降等休克症状。